当牙周炎较重时，基础治疗时不应做的处理措施是
A. 牙周冲洗，2％碘甘油涂敷
B. 龈上洁治术
C. 牙龈翻瓣术
D. 根面平整术
E. 使用足量的抗生素

正确答案：C。牙龈翻瓣术

解析：本题考查牙周基础治疗。牙龈翻瓣术（C错，为本题正确答案）是牙周手术的一种，在牙周病的治疗计划中，手术治疗必须在基础治疗之后进行。牙周的基础治疗以消除致病因素，控制牙龈炎症为目的。包括施行洁治术（B对）、根面平整术（D对）以消除龈上和龈下菌斑、牙石；教育并指导患者自我控制菌斑的方法如正确刷牙等；消除菌斑滞留因素及其他局部刺激因素；咬合调整等；对于重度牙周炎，还可进行药物治疗，如牙周冲洗，2％碘甘油涂敷（A对）；使用足量的抗生素（E对），以改善疗效。